一小儿身高85cm，头围48cm，乳牙20枚，能跳，能表达自己的意愿。此小儿的年龄最可能是
A. 6个月
B. 1岁
C. 2岁
D. 3岁
E. 4岁

正确答案：C。2岁

解析：小儿1岁时身长75cm，第2年身长生长速度减慢，约10-12cm，即2岁身长约87cm。小儿出生时头围平均33-34cm，1岁时头围46cm，生后第2年头围仅增长2cm，即2岁时头围48cm。乳牙一共20颗，约2.5岁出齐。小儿运动发育可概括为“三抬四翻六会坐，七滚八爬周（周岁）会走，两岁会跳，三岁会跑”。根据以上可判断此小儿为2岁（C对）。